男，42岁。发热2周，持续胸痛1天。既往体健。吸烟20年。查体：血压110/80mmHg，双肺呼吸音清，心率105次/分，律齐。心电图：除aVR导联外的导联ST段呈弓背向下抬高。实验室检查：血肌钙蛋白阴性。该患者胸痛的最可能原因是
A. 急性心包炎
B. 气胸
C. 急性心肌梗死
D. 变异型心绞痛
E. 病毒性心肌炎

正确答案：A。急性心包炎

解析：患者发热2周后，出现胸痛1天，心电图：除aVR导联外的导联ST段呈弓背向下抬高。根据患者的病史和心电图检查，最有可能的诊断是急性心包炎（A对）。气胸（B错）双肺听诊呼吸音一般减弱，心电图无上述变化。胸痛伴心电图ST段抬高需要与急性心肌梗死（C错）鉴别，后者抬高的ST段弓背向上，ST-T改变的演变在数小时内发生，改变导联与梗死血管相对应，范围通常不如心包炎时广泛。实验室检查：血肌钙蛋白I（cTnI）或T（cTnT）起病3～4小时后升高（P239）。变异性心绞痛（D错）特征为静息心绞痛，表现为一过性ST段动态改变（抬高）（P229）。病毒性心肌炎（E错）多数患者发病前1~3周有病毒感染前驱症状，如发热、全身倦怠感等，随后可以有心悸、胸痛、呼吸困难、水肿，甚至晕厥、猝死。常见S-T改变，包括ST段轻度移位和T波倒置（P270）。